了解一个药品是否为进口分装，最简单方法是
A. 打电话给出售该药品的企业查询
B. 打电话给邻近的口岸药检所查询
C. 打电话给药品注册的行政部门查询
D. 查看包装上批准文号内有否标识英文大写字母“F”字
E. 查看包装上批准文号内有否标识英文大写字母“J”字

正确答案：E。查看包装上批准文号内有否标识英文大写字母“J”字